女性患者因右腮腺肿物行“右腮腺浅叶及肿物切除术加面神经解剖术”，术后3天发现右眼不能闭合，皱眉力弱，额纹存在，眼睑以下无明显面瘫表现。该患者术中可能损伤了
A. 面神经主干
B. 面神经额支
C. 面神经颞支
D. 面神经上、下颊支
E. 面神经颧支

正确答案：E。面神经颧支

解析：本题考查面神经损伤。上下眼轮匝肌受颧支支配，所以右眼不能闭合，说明右侧面神经颧支损伤（E对）。由于额肌受面神经颞支支配，所以额纹存在，说明右侧面神经颞支（C错）完好。眼睑以下的面部肌肉受颊支、下颌缘支支配，所以眼睑以下无明显面瘫表现说明面神经上、下颊支（D错）、下颌缘支完好；面神经主干损伤（A错）则同侧出现面瘫；面神经的分支没有额支（B错）。